大气颗粒物最重要的性质是
A. 密度
B. 粒径
C. 颜色
D. 形状
E. pH

正确答案：B。粒径

解析：本题考查大气颗粒物最重要的性质。大气颗粒物最重要的性质是粒径（B对ACDE错），它反映了大气颗粒物来源的本质，并可影响光散射性质和气候效应。大气颗粒物的许多性质如体积、质量和沉降速度都与颗粒物的大小有关。